小儿反复呼吸系统感染的可能原因不包括
A. 先天性免疫功能缺陷
B. 维生素A缺乏
C. 抵抗力差
D. 照顾不周
E. 过敏

正确答案：E。过敏

解析：小儿反复呼吸系统感染的可能原因：先天性免疫功能缺陷（A对）、维生素A缺乏（B对）、抵抗力差（C对）、照顾不周（D对），过敏不是可能原因。还可能与环境、精神慢性疾病等有关（E错，为本题正确答案）。